某男，60岁，经常脘腹冷痛，呕吐或腹泻，喜食热饮，且时有阳痿不举，证属脾胃虚寒、肾阳亏虚，宜选用的药是
A. 丁香
B. 陈皮
C. 乌梅
D. 香附
E. 干姜

正确答案：A。丁香

解析：本题考查的是丁香的主治病证。经常脘腹冷痛，呕吐或腹泻，喜食热饮，且时有阳痿不举，证属脾胃虚寒、肾阳亏虚，宜选用的药是丁香（A对）。丁香：【主治病证】（1）中寒呃逆、呕吐、泄泻，脘腹冷痛。（2）肾阳虚之阳痿、宫冷。陈皮（B错）：【主治病证】（1）脾胃气滞之脘腹胀满或疼痛、嗳气、恶心呕吐。（2）湿浊中阻之胸闷腹胀、纳呆便溏。（3）痰湿壅肺之咳嗽气喘。乌梅（C错）：【主治病证】（1）肺虚久咳。（2）久泻久痢。（3）虚热消渴。（4）蛔厥腹痛。（5）崩漏，便血。香附（D错）：【主治病证】（1）肝气郁滞之胸胁、脘腹胀痛，疝气痛。（2）肝郁之月经不调、痛经、乳房胀痛。（3）脾胃气滞，脘腹胀痛。干姜（E错）：【主治病证】（1）脾胃受寒或虚寒所致的腹痛、呕吐、泄泻。（2）亡阳欲脱。（3）寒饮咳喘。